普鲁卡因不宜用于哪种麻醉
A. 表面麻醉
B. 浸润麻醉
C. 传导麻醉
D. 硬膜外麻醉
E. 蛛网膜下腔麻醉

正确答案：A。表面麻醉

解析：普鲁卡因，又称奴佛卡因，毒性较小，是常用的局麻药物之一。属于短效酯类麻醉剂，对黏膜的穿透力弱。一般不用于表面麻醉。长局部注射可用于浸润麻醉、传导麻醉、蛛网膜下腔麻醉和硬膜外麻醉。掌握“局麻药”知识点。